患者老年，有慢性支气管炎及高血压病史15年，近半年活动后自觉气短。检查：血压160/95mmHg（21.3/12.6kPa），心脏听诊未闻及器质性杂音，两肺听诊无异常，心电图及X线显示左心室增大。应首先考虑的是
A. 肺心病
B. 风心病
C. 冠心病
D. 高血压性心脏病
E. 病毒性心肌炎

正确答案：D。高血压性心脏病

解析：患者有慢性支气管炎及高血压病史15年，近半年活动后自觉气短，检查发现血压升高明显，心脏听诊未闻及器质性杂音，两肺听诊无异常，心电图及X线显示左心室增大，可为血压持续升高致左心室肥厚、扩大形成高血压性心脏病（D对），最终可导致充血性心力衰竭。部分高血压患者可并发冠状动脉粥样硬化，并可出现心绞痛、心肌梗死，心力衰竭及猝死。肺心病（A错）一般表现为肺动脉高压和右心室肥大，伴或不伴有右心功能衰竭。风心病（B错）的特点为心脏听诊常闻及器质性杂音。冠心病（C错）的特点为阵发性心前区压榨样疼痛，并向左肩部、左上肢内侧放射，休息或服用硝酸酯制剂后缓解。病毒性心肌炎（E错）的特点为发热，咽痛，腹泻，全身酸痛，然后出现心悸心慌、胸闷胸痛，倦怠乏力等。